酮症酸中毒时应静脉给予的是
A. 开环胰岛素给药装置
B. 闭环胰岛素给药装置
C. 短效胰岛素制剂
D. 中效胰岛素制剂
E. 长效胰岛素制剂

正确答案：C。短效胰岛素制剂